男性，52岁，1周来出现阵发性夜间心前区闷胀，伴出汗，每次持续约10分钟，能自行缓解，白天可正常工作。1小时前在熟睡中再发心前区胀痛，明显压抑感，自服速效救心丸无效，症状持续不缓解而来院。既往体健，无类似发作。入院查心电图呈心前区导联ST段抬高。该患者最可能的诊断是
A. 劳力型心绞痛
B. 初发型心绞痛
C. 恶化型心绞痛
D. 变异型心绞痛
E. 梗死后心绞痛

正确答案：D。变异型心绞痛